咳声重浊者，多属于
A. 风寒
B. 寒湿
C. 痰饮
D. 燥热
E. 肺热

正确答案：A。风寒

解析：风寒之邪侵袭肺部，肺气失于宣降，所以咳声重浊，痰白质清稀，鼻塞不通（A对）。寒痰湿浊（B错）停聚在肺部，肺气失于肃降故咳声重浊沉闷，常为实证。痰饮停肺（C错）则见咳嗽痰多，易于咯出。燥邪（D错）犯肺或阴虚肺燥，患者干咳无痰或痰少而黏，不易咯出。热邪犯肺（E错），灼伤肺津，则患者咳嗽声音高亢响亮，痰稠色黄，不易咯出。